毒性最大的局麻药是
A. 普鲁卡因
B. 利多卡因
C. 丁卡因
D. 布比卡因
E. 依替卡因

正确答案：C。丁卡因

解析：蒂娜卡因又称地卡因。属于酯类局麻药。其麻醉强度比普鲁卡因强10倍，毒性大10～12倍。本药对黏膜的穿透力强，常用于表面麻醉。可用于传导麻醉、腰麻和硬膜外麻醉，因毒性大，一般不用于浸润麻醉。而其他局麻药的毒性均小于丁卡因。掌握“局麻药”知识点。